某女，70岁。素患消渴，近日又发痈肿疮疡。宜选用的中药是
A. 知母
B. 天花粉
C. 谷精草
D. 夏枯草
E. 芦根

正确答案：B。天花粉

解析：本题考查天花粉的主治病证。宜选用的中药是天花粉（B对）。天花粉【主治病证】（1）热病伤津口渴，内热消渴。（2）肺热咳嗽，燥咳痰黏，咳痰带血。（3）痈肿疮疡，跌打肿痛。此外，制成天花粉蛋白注射液肌内注射又能引产。知母（A错）【主治病证】（1）热病壮热烦渴。（2）肺热咳嗽，燥热咳嗽，阴虚劳嗽。（3）阴虚火旺，潮热盗汗。（4）内热消渴，阴虚肠燥便秘。谷精草（C错）【主治病证】（1）风热目赤，肿痛羞明，目生翳膜。（2）风热头痛。夏枯草（D错）【主治病证】（1）肝阳或肝火上升之头目眩晕。（2）目赤肿痛，目珠夜痛。（3）痰火郁结之瘰疬、瘿瘤。芦根（E错）【主治病证】（1）热病烦渴，舌燥少津。（2）胃热呕哕。（3）肺热或外感风热咳嗽，肺痈吐脓。（4）小便短赤，热淋涩痛。